1988年1月19日，某市急性病毒性肝炎疫情骤然上升，数日内发病人数成倍增长，至3月18日，共发生急性病毒性肝炎292301例，平均罹患率82‰，为常年发病率的12倍。死亡11例，病死率为76/10万。该现象属于
A. 散发
B. 暴发
C. 流行
D. 长期趋势
E. 周期性

正确答案：C。流行